与糖缩合能生成可水解鞣质的是
A. 没食子酸
B. 绿原酸
C. 二者均有
D. 二者均无

正确答案：A。没食子酸

解析：本题考查的是鞣质。与糖缩合能生成可水解鞣质的是没食子酸（A对）。五倍子中主要鞣质及其化学结构：五倍子中的主要有效成分为鞣质，《中国药典》上收载的五倍子鞣质，称为鞣酸，又叫单宁酸。因五倍子盛产于我国，国际上又将五倍子鞣质称为中国鞣质，它是倍酰葡萄糖的混合物，即葡萄糖上的羟基与没食子酸所形成的酯类化合物的混合物，属水解类鞣质。绿原酸（B错）为一分子咖啡酸与一分子奎宁酸结合而成的酯，即3-咖啡酰奎宁酸。